对Kennedy第一、二类缺失修复体的设计要点是，除外
A. 取压力印模
B. 增加间接固位体支持
C. 减轻主要基牙上的牙合力
D. 排列与天然牙等大的人工牙
E. 扩大鞍基，使牙合力均匀分布在牙槽嵴上

正确答案：D。排列与天然牙等大的人工牙

解析：本题考查Kennedy第一、二类缺失修复体的设计要点。排列与天然牙等大的人工牙（D错，为本题的正确答案）会使修复体所受的（牙合）力增大，增加基牙负担，正确的设计应为人工牙减径减数。Kennedy第一、二类缺失均有游离端缺失，此类修复体需要游离端黏膜承受压力，需要取压力印模（A对）以增加密合度。游离端缺失，余留牙的固位力不足，可增加间接固位体（B对），减轻主要基牙上的（牙合）力（C对）。扩大鞍基，使（牙合）力均匀分布在牙槽嵴上（E对），增大黏膜可承受的压力。